患者呕吐吞酸，胸胁胀满，嗳气频作，脘闷食少，其证候是
A. 胃阳虚证
B. 肝胃不和证
C. 肝脾不调证
D. 食滞胃脘证
E. 胃阴虚证

正确答案：B。肝胃不和证

解析：“肝胃不和证，临床表现为胃脘、胁肋胀满疼痛，走窜不定，嗳气，吞酸嘈杂，呃逆，不思饮食，情绪抑郁，善太息，或烦躁易怒，舌淡红，苔薄黄，脉弦，本证以脘胁胀痛、嗳气、吞酸、情绪抑郁等为辨证的主要依据”，本题临床表现与之相符，结合辨证依据，肝气犯胃，胃气上逆，木郁作酸，故见呕吐吞酸，嗳气频作；情志不遂，肝失疏泄，故见胸胁胀满；胃不主受纳，故见脘闷食少，故其证候为肝胃不和证（B对）。“胃阳虚证，临床表现为胃脘冷痛，绵绵不已，时发时止，喜温喜按，食后缓解，泛吐清水或夹有不消化食物，食少脘痞，口淡不渴，倦怠乏力，畏寒肢冷，舌淡胖嫩，脉沉迟无力”，本题临床表现与之不符(A错)。“肝脾不调证，即肝郁脾虚证，临床表现为胸胁胀满窜痛，善太息，情志抑郁，或急躁易怒，食少，腹胀，肠鸣矢气，便溏不爽，或腹痛欲便、泻后痛减，或大便溏结不调，舌苔白，脉弦或缓”，本题临床表现与之不符（C错）。“食滞胃脘证，脘腹胀满疼痛、拒按，厌食，嗳腐吞酸，呕吐酸馊食物，吐后胀痛得减，或腹痛，肠鸣，矢气臭如败卵，泻下不爽，大便酸腐臭秽，舌苔厚腻，脉滑或沉实”，本题临床表现与之不符（D错）。“胃阴虚证，临床表现为胃脘嘈杂，饥不欲食，或痞胀不舒，隐隐灼痛，干呕，呃逆，口燥咽干，大便干结，小便短少，舌红少苔乏津，脉细数”，本题临床表现与之不符（E错）。